用两种方法检查已确诊的肺癌患者100名，甲法检出68名，乙法检出54名，甲、乙两法一致的检出数为38名。欲比较两种方法的检出结果有无区别，其检验假设H₀为
A. μ₁=μ₂
B. μ₂=0
C. π₁=π₂
D. b=c
E. P₁=P₂

正确答案：C。π₁=π₂